我国劳动保护规定妇女不宜从事的体力劳动是
A. 矿山井下工作和森林伐木作业
B. 森林伐木和高空作业
C. 高空作业和重体力劳动
D. 矿山井下工作、森林伐木和高空作业
E. 重体力劳动、夜班工作和高空作业

正确答案：D。矿山井下工作、森林伐木和高空作业